急性机械性肠梗阻引起的首要病理生理改变是
A. 呼吸衰竭
B. 感染
C. 体液丧失
D. 毒素中毒
E. 休克

正确答案：C。体液丧失

解析：急性机械性肠梗阻时，肠腔内因气体和液体积聚而膨胀，压力不断升高，使肠壁充血水肿、毛细血管通透性增加，液体外渗，同时胃肠道分泌的液体不能被吸收返回全身血液循环而积存在肠腔，导致体液丢失在第三间隙。此外，呕吐可丢失大量消化液，使体液进一步减少。体液丧失可引起水、电解质紊乱、酸碱失衡及休克等。因此，急性机械性肠梗阻引起的首要病理生理改变是体液丧失（C对）。肠膨胀时腹压增高，横膈上升，影响肺内气体交换，严重者可出现呼吸衰竭；肠梗阻时肠壁充血水肿，肠黏膜免疫屏障遭到破坏，大量毒素、细菌进入血液循环，可引起中毒、感染；大量体液丢失、细菌感染、中毒等可引起低血容量性休克和失血性休克，但呼吸衰竭（A错）、感染（B错）、毒素中毒（D错）、休克（E错）均不是肠梗阻的首要病理生理改变。